无机汞的最后蓄积脏器为
A. 肾脏
B. 脾脏
C. 骨骼
D. 肝脏
E. 血液

正确答案：A。肾脏